牙周手术的垂直切口的最佳部位应选择在
A. 相邻健康牙的颊／舌侧龈中点
B. 相邻健康牙的近、远中轴面角处
C. 相邻健康牙的龈乳头处
D. 相邻健康牙的牙根最突出处
E. 病变区骨边缘

正确答案：B。相邻健康牙的近、远中轴面角处

解析：本题考查牙周手术的垂直切口的部位。牙周手术翻瓣术中经常采用的切口方式有水平切口、纵行切口、保留龈乳头切口，其纵切口的位置应在术中纵行切口也称垂直切口，是在水平切口的近中端或近远中两端做的纵行切口，目的是为了减少组织张力、更好地暴露术区。纵切口的位置应在术区近、远中侧比较健康的牙龈组织上，位于牙的颊面轴角处（B对），此处血运丰富有利于愈合，一般将龈乳头包括在龈瓣内，以利于术后缝合。在相邻健康牙的颊/舌侧龈中点（A错）、相邻健康牙的龈乳头处（C错）做切口不利于纵切口的愈合。在相邻健康牙的牙根最突出处做（D错）做切口，由于此处牙龈组织薄弱不易于纵行切口愈合。病变区骨边缘（E错）的牙龈组织有炎症不利于纵行切口愈合。